二级预防的核心是
A. 早期发现
B. 早期诊断
C. 早期治疗
D. 早期隔离

正确答案：B。早期诊断

解析：本题考查二级预防的核心。第二级预防又称“三早”预防，即早发现、早诊断、早治疗。第二级预防是在疾病早期，症状体征尚未表现出来或难以觉察，通过及早发现并诊断疾病，及时给予适当的治疗，有更大的机会实现治愈；或者如果疾病无法治愈，可以通过治疗阻止疾病发展到更严重的阶段或至少减缓发展进程，减少对更复杂的治疗措施的需要。二级预防的核心是早期诊断（B对ACD错）。